X线片上难以显示的牙槽骨吸收方式是
A. 水平型牙槽骨吸收
B. 垂直型牙槽骨吸收
C. 凹坑状牙槽骨吸收
D. 反波浪型牙槽骨吸收
E. 扶壁骨形成

正确答案：C。凹坑状牙槽骨吸收

解析：本题考查牙槽骨吸收的X线表现。X线片上难以显示的牙槽骨吸收方式是凹坑状牙槽骨吸收（C对）。邻面的垂直吸收在X线片上很容易发现，大多数垂直吸收都形成骨下袋，但在X线片上难以确定是几壁骨袋，只有在手术翻开牙龈后才能确定；凹坑状吸收也难以在X线片上显示。水平型吸收牙槽嵴高度降低，形成骨上袋（A错）。垂直型吸收又称角型吸收，是牙槽骨发生垂直向或斜行吸收，与牙根面之间形成一定角度的吸收（B错）。当牙槽间隔破坏下凹，而颊舌面骨嵴未吸收时，使骨嵴呈反波浪状吸收，X线可见（D错）。扶壁骨形成为骨的修复性改变，使唇颊面骨壁增生，X线可见（E错）。